下列哪项可引起心率减慢
A. 交感神经活动增强
B. 迷走神经活动增强
C. 肾上腺素
D. 甲状腺激素
E. 发热

正确答案：B。迷走神经活动增强